流行性出血热患者全身各组织器官都可有充血出血变性坏死，表现最为明显的器官是
A. 心
B. 肺
C. 肾
D. 脑垂体
E. 胃肠

正确答案：C。肾

解析：流行性出血热的基本病理改变以小血管、肾脏最为明显（C对），其次为心（A错）、肺（B错）、肝和脑（D错）等。